下列哪种肉经过适当处理后可以食用
A. 患炭疽病的牲畜
B. 患口蹄疫的牲畜
C. 严重结核病的牲畜
D. 不明原因死亡的牲畜
E. 严重感染囊尾蚴的牲畜

正确答案：B。患口蹄疫的牲畜